地高辛易引起
A. 药源性急性胃溃疡
B. 药源性肝病
C. 药源性耳聋
D. 药源性心血管损害
E. 药源性血管神经性水肿

正确答案：D。药源性心血管损害

解析：本题考查药源性疾病。引起药源性心血管系统损害（D对）的药物：（1）心律失常：地高辛；（2）心动过速：麻黄碱、去氧肾上腺素、酚妥拉明等；（3）尖端扭转型室性心动过速：奎尼丁、利多卡因等；引起药源性肝病（B错）：四环素类、他汀类等；引起药源性耳聋（C错）与听力障碍的药物有：氨基糖苷类抗生素、非甾体抗炎药、高效利尿药等；引起药源性血管神经性水肿（E错）的药物有：卡托普利、依那普利等。